胰岛素受体β亚基可具有下列哪种酶活性
A. 蛋白激酶A
B. 蛋白激酶C
C. 蛋白激酶G
D. 酪氨酸蛋白激酶
E. CaM激酶

正确答案：D。酪氨酸蛋白激酶